男性，20岁，临床诊断为局限型侵袭性牙周炎，在牙周基础治疗的同时准备给予全身抗生素治疗，最佳选择是
A. 甲硝唑+阿莫西林
B. 米诺环素
C. 青霉素
D. 非甾体类抗炎药
E. 链霉素

正确答案：A。甲硝唑+阿莫西林

解析：局限型侵袭性牙周炎的主要致病菌有伴放线放线杆菌，为兼性厌氧菌，甲硝唑对其无抑制和杀菌作用，大量研究表明，四环素族药物对其有效，米诺环素是半合成的四环素族药物，抑菌谱广且抑菌活性强。但是由于我国80年代四环素滥用，导致菌群耐药，至今国内治疗局限性侵袭性牙周炎的主要用药是甲硝唑+阿莫西林。掌握“侵袭性牙周炎”知识点。